分布区域缩小，资源处于衰竭状态的重要野生物种药材是
A. 羚羊角
B. 丹参
C. 黄芩
D. 甘草

正确答案：D。甘草

解析：本题考查野生药材资源保护。分布区域缩小，资源处于衰竭状态的重要野生物种药材是甘草（D对）。国家重点保护野生药材物种的分级和管理：国家重点保护的野生药材物种分为三级管理。一级保护野生药材物种：系指濒临灭绝状态的稀有珍贵野生药材物种。二级保护野生药材物种：系指分布区域缩小，资源处于衰竭状态的重要野生药材物种。三级保护野生药材物种：系指资源严重减少的主要常用野生药材物种。国家重点保护的野生药物种名录共收载了野生药材物种76种，中药材42种。其中一级保护的野生药材物种有4种，中药材4种；二级的野生药材物种27种，中药材17种；三级保护的野生药材物种45种，中药材21种。国家药品监督管理部门会同野生动物、植物管理部门负责制定国家重点保护的野生药材物种名录的工作。县级以上药品监督管理部门会同同级野生动物、植物管理部门制定采猎、收购二、三级保护野生药材物种的计划，报上一级药品监督管理部门批准。县级以上药品监督管理部门会同同级野生动物、植物管理部门确定禁止采猎区、禁止采猎期和禁止使用采猎的工具。国家药品监督管理部门负责确定采药证的格式，县级以上药品监督管理部门会同同级野生动物、植物管理部门负责采药证的核发。国家药品监督管理部门会同国务院有关部门负责确定实行限量出口和出口许可证制度的品种，确定野生药材的规格、等级标准。国家重点保护的野生药材名录：（1）一级保护药材名称：虎骨、豹骨、羚羊角（A错）、鹿茸（梅花鹿）。（2）二级保护药材名称：鹿茸（马鹿）、麝香（3个品种）、熊胆（2个品种）、穿山甲、蟾酥（2个品种）、哈蟆油、金钱白花蛇、乌梢蛇、蕲蛇、蛤蚧、甘草（3个品种）、黄连（3个品种）、人参、杜仲、厚朴（2个品种）、黄柏（2个品种）、血竭。（3）三级保护药材名称：川贝母（4个品种）、伊贝母（2个品种）、刺五加、黄芩（C错）、天冬、猪苓、龙胆（4个品种）、防风、远志（2个品种）、胡黄连、肉苁蓉、秦艽（4个品种）、细辛（3个品种）、紫草、五味子（2个品种）、蔓荆子（2个品种）、诃子（2个品种）、山茱萸、石斛（5个品种）、阿魏（2个品种）、连翘（2个品种）、羌活（2个品种）。